通过疾病的现况调查（时间范围较短），可以得到某病的
A. 出生率
B. 发病率
C. 患病率
D. 病死率
E. 罹患率

正确答案：C。患病率